有关蛋白质变性的叙述，错误的是
A. 蛋白质变性时其一级结构不受影响
B. 蛋白质变性时其理化性质发生变化
C. 蛋白质变性时其生物学活性降低或丧失
D. 去除变性因素后变性蛋白质都可以复原
E. 球蛋白变性后其水溶性降低

正确答案：D。去除变性因素后变性蛋白质都可以复原